任脉的生理作用主要是
A. 通调冲、任
B. 调节任、督
C. 总调奇经八脉
D. 调节阴经经气
E. 总调冲、任、督、带

正确答案：D。调节阴经经气

解析：任脉主干行于腹，腹为阴，诸阴经皆交会于任脉。任脉总任六阴经，调节全身阴经经气（D对）。